目前，口腔颌面部癌症患者的5年生存率在
A. 30%左右
B. 40%左右
C. 50%左右
D. 60%左右
E. 70%左右

正确答案：D。60%左右

解析：目前，口腔颌面部癌症患者的5年生存率在60%左右，效果尚不能令人满意。其原因为现在癌症的治疗都是一种“癌后治疗”，即在癌症已形成之后。掌握“口腔颌面部肿瘤的治疗原则及预防”知识点。